对于共源性暴发
A. 不能用潜伏期来推算暴露日期或时间范围
B. 可从流行曲线的尾部向前倒推两个常见潜伏期来推算暴露日期或时间范围
C. 可从流行曲线的前部向前倒推一个最长潜伏期来推算暴露日期或时间范围
D. 可从发病高峰倒推一个常见潜伏期来推算暴露日期或时间范围
E. 可从发病高峰倒推一个最短潜伏期来推算暴露日期或时间范围

正确答案：D。可从发病高峰倒推一个常见潜伏期来推算暴露日期或时间范围

解析：同源性爆发的暴露时间推算方法有两种：一是从位于中位数的病例的发病日期（或流行曲线的高峰处）向前推一个平均潜伏期，即为同源暴露的近似日期。另一种方法是从第一例发病日期向前推一最短潜伏期7天，再从最后一个病例发病日期向前推一个最长潜伏期21天，这两个时点之间，即这两个时间点之前的某个时间可能是同源暴露的时间。